釉质脱矿常从其表面下层开始，有时可能在看似完整的釉质下方形成龋洞，临床常常漏诊，称为
A. 平滑面龋
B. 隐匿性龋
C. 猖獗龋
D. 慢性龋
E. 线性釉质龋

正确答案：B。隐匿性龋

解析：本题考查龋病概述。隐匿性龋（B对）：釉质脱矿常从其表面下层开始，有时可能在看似完整的釉质下方形成龋洞，因其具有隐匿性，临床检查常易漏诊。